某男，17岁，暑湿季节，突发泄泻腹痛，变黄而黏，肛门灼热，舌质红，苔黄薄腻，脉滑数。医师诊断为湿热蕴结之泄泻，处以中成药葛根芩连丸，连续服用3天，诸症悉除。葛根芩连丸处方组成，除葛根、黄连、黄芩外，还有
A. 连翘
B. 炙甘草
C. 蜂蜜
D. 胡黄连
E. 木香

正确答案：B。炙甘草

解析：本题考查的是葛根芩连丸的药物组成。葛根芩连丸处方组成，除葛根、黄连、黄芩外，还有炙甘草（B对）。葛根芩连丸：【药物组成】葛根、黄芩、黄连、炙甘草。